实验设计的基本原则
A. 随机化、盲法、设置对照
B. 重复、随机化、配对
C. 随机化、盲法、配对
D. 齐同、均衡、随机化
E. 随机化、重复、设置对照、盲法

正确答案：E。随机化、重复、设置对照、盲法

解析：本题考查实验设计的基本原则。实验设计的基本原则包括：①随机化原则；②对照原则；③可重复性原则；④盲法原则（E对ABCD错）。